成人心脏正常二尖瓣瓣口面积是
A. 0.5～1.0cm²
B. 2.0～3.0cm²
C. 4.0～6.0cm²
D. 6.5～7.5cm²
E. 8.0～9.0cm²

正确答案：C。4.0～6.0cm²

解析：成人心脏正常二尖瓣瓣口面积是4.0～6.0cm²（C对ABDE错）。瓣口面积减小至1.5～2.0cm²属轻度狭窄；1.0～1.5cm²属中度狭窄；＜1.0cm²属重度狭窄。